对于鸡蛋中铁的叙述正确的是
A. 含量较低
B. 营养价值很低
C. 人体吸收率较高
D. 主要存在于蛋清中
E. 主要存在于蛋黄中

正确答案：E。主要存在于蛋黄中